下列哪项与动脉血氧含量无关
A. Hb的量
B. 血液的携氧能力
C. 吸入气氧分压
D. 外呼吸功能
E. 内呼吸状况

正确答案：E。内呼吸状况

解析：100ml血液中实际含有的氧量称为血氧含量，其取决于血氧分压与血氧容量。其中动脉血氧分压的高低主要取决于吸入的氧分压（C对）和肺的外呼吸功能（D对)。血氧容量取决于血液中Hb的含量（A对）及血液的携氧能力（B对E错，为本题正确答案）。